治病时考虑年龄属于
A. 治病求本
B. 扶正祛邪
C. 因时制宜
D. 因地制宜
E. 因人制宜

正确答案：E。因人制宜

解析：年龄不同，则生理功能、病机变化各异，治宜区别对待，如小儿生机旺盛，但脏腑娇嫩，气血未充，发病则易寒易热，易虚易实，病情变化较快，因而，治疗小儿疾病，药量宜轻，疗程宜短，忌用峻剂；青壮年则气血旺盛，脏腑充实，病发则由于邪正相争剧烈而多表现为实证，可侧重于攻邪泻实，药量亦可稍重；而老年人生机减退，气血日衰，脏腑功能衰减，病多表现为虚证，或虚中夹实，因而，多用补虚之法，或攻补兼施，用药量应比青壮年少，中病即止，所以应根据患者的年龄，制定适宜治法和方药的原则，称为“因人制宜”（E对）。